甲报社对某假药进行虚假宣传，构成犯罪，其罪名应定为
A. 生产、销售假药罪
B. 生产、销售劣药罪
C. 生产、销售伪劣商品罪
D. 虚假广告罪
E. 非法经营罪

正确答案：C。生产、销售伪劣商品罪

解析：本题考查药品安全法律责任。甲报社对某假药进行虚假宣传，构成犯罪，其罪名应定为生产、销售伪劣商品罪（C对）。